关于病例对照研究中病例组的选择，下列说法正确的是
A. 病例组不能患有其他疾病
B. 病例组必须从医院中选取
C. 病例组是无危险因素暴露史者
D. 病例组的选择不能受暴露史的影响
E. 病例组应是具有危险因素暴露史者

正确答案：D。病例组的选择不能受暴露史的影响

解析：本题考查病例对照研究的病例组。病例对照研究中病例组是当前已经确诊的患有某特定疾病的一组病人，且病例组的选择不能受暴露史的影响（D对ABCE错）。